某患者主诉左侧面部感觉麻痹，刺激左眼角膜而左眼眨眼反射消失，但刺激右眼角膜，左眼眨眼反射正常。此外，病人下颌前突时偏向左侧，身体对侧痛温觉丧失，以及粗意向震颤和倾向左侧跌倒。对该病人已引起这些体征的脑病变很可能位于
A. 延髓上部的内侧部
B. 延髓下部的后外侧部
C. 脑桥中部的内侧部
D. 脑桥中部的外侧部
E. 中脑基底部

正确答案：D。脑桥中部的外侧部

解析：患者左侧面部感觉麻痹，刺激左眼角膜而左眼眨眼反射消失，但刺激右眼角膜，左眼眨眼反射正常，为三叉神经损伤的表现。此外，病人下颌前突时偏向左侧，身体对侧痛温觉丧失，是躯干和四肢意识性本体感觉的精细触觉传导通路障碍，病变在丘脑后外侧核。粗意向震颤和倾向左侧跌倒，是小脑病变所致。综上，脑桥中部的外侧部（D对）的病变最有可能。